关于胸膜返折线，其下界在锁骨中线处约相交于
A. 第6肋
B. 第7肋
C. 第8肋
D. 第9肋
E. 第10肋

正确答案：C。第8肋

解析：胸膜返折线，其下界在锁骨中线处约相交于第8肋（C对）。